厚朴酚的结构类型是
A. 黄酮类
B. 香豆素类
C. 蒽醌类
D. 木脂素类
E. 生物碱类

正确答案：D。木脂素类

解析：本题考查的是厚朴的主要成分。厚朴酚的结构类型是木脂素类（D对）。厚朴中主要化学成分为木脂素类化合物，包括厚朴酚以及和厚朴酚等，《中国药典》采用高效液相色谱法测定药材中厚朴酚与和厚朴酚含量，两者总含量不得少于2.0%。黄酮类（A错）化合物广泛存在于自然界中，多存在于高等植物及羊齿类植物中。苔类中含有的黄酮类化合物为数不多，而藻类、霉菌、细菌中没有发现黄酮类化合物。含黄酮类化合物的中药有黄芩、葛根、银杏叶、槐花、陈皮、满山红等。香豆素类（B错）：香豆素是邻羟基桂皮酸的内酯，广泛分布于高等植物中，尤其以芸香科和伞形科为多见，少数发现于动物和微生物中。含香豆素的常用中药有秦皮、前胡、肿节风、补骨脂等。在植物体内，它们往往以游离状态或与糖结合成苷的形式存在。香豆素类在可见光下为无色或浅黄色结晶。香豆素母体本身无荧光，而羟基香豆素在紫外光下多显出蓝色荧光，在碱溶液中荧光更加显著。蒽醌类（C错）成分包括蒽酮及其不同还原程度的产物。含蒽醌类成分的药材有大黄、虎杖、茜草、何首乌、芦荟、决明子等。生物碱（E错）类主要分布于植物界，在动物界中少有发现。生物碱绝大多数存在于双子叶植物中，已知有50多个科的120多个属中存在生物碱。与中药有关的典型的科有毛茛科（黄连属黄连，乌头属乌头、附子）、防己科（汉防己、北豆根）、罂粟科（罂粟、延胡索）、茄科（曼陀罗属洋金花、颠茄属颠茄、莨菪属莨菪）、马钱科（马钱子）、小檗科（三颗针）、豆科（苦参属苦参、槐属苦豆子）等。单子叶植物也有少数科属存在生物碱，如石蒜科、百合科（贝母属的川贝母、浙贝母）、兰科等。少数裸子植物如麻黄科、红豆杉科、三尖杉科和松柏科也存在生物碱。低等植物中仅发现极个别的存在生物碱，如烟碱存在于蕨类植物中，麦角生物碱存在于菌类植物中。地衣、苔藓类植物中仅发现少数简单的吲哚类生物碱。藻类、水生类植物中未发现生物碱。